患者高热1周。检查：体温40℃，脉搏90次/分钟，血白细胞4.0×10⁹/L，嗜酸性粒细胞消失。应首先考虑的是
A. 伤寒
B. 中毒性痢疾
C. 中毒性肺炎
D. 流行性脑脊髓膜炎
E. 急性病毒性肝炎

正确答案：A。伤寒

解析：患者高热，血白细胞4.0×10⁹/L，嗜酸性粒细胞消失可明确诊断患者为伤寒。伤寒患者血常规检查白细胞计数一般在（3～5）×10⁹/L之间，中性粒细胞减少，可能与骨髓的粒细胞系统受到细菌毒素的抑制、粒细胞的破坏增加和分布异常有关。嗜酸性粒细胞减少或消失，病情恢复后逐渐回升到正常，复发时再度减少或消失。嗜酸性粒细胞计数对诊断和评估病情均有重要的参考意义（A对）。中毒型菌痢在儿童多见，夏秋季节发病，突起高热、反复惊厥、意识障碍、循环衰竭和（或）呼吸衰竭表现者，均应考虑中毒型菌痢（B错）。中毒性肺炎主要表现为胸闷，胸痛，气急，剧咳，咳痰，有时痰中带有血丝。一般白细胞总数和中性粒细胞比例均增高，2到3天内可恢复正常，如果白细胞持续增高，则有继发细菌感染的可能，x线征象可有局部片状阴影和密度不高的点状阴影，肺纹理增粗，边缘不整，上肺野较为清晰（C错）。流行性脑脊髓膜炎主要临床表现是突发高热、剧烈头痛、频繁呕吐，皮肤黏膜瘀点、瘀斑及脑膜刺激征，严重者可有败血症休克和脑实质损害，常可危及生命。部分患者暴发起病，可迅速致死。本病经呼吸道传播，冬春季多见。全球分布，呈散发或流行，儿童发病率高。患者高热，头痛伴呕吐且颈项强直，克氏征阳性，脑脊液外观混浊，可明确诊断为流行性脑脊髓膜炎（D错）。急性病毒性肝炎：①急性黄疽性肝炎：起病较急，有畏寒、发热、乏力、厌食、厌油、恶心、呕吐等症状，约1周后尿色深黄，继而巩膜及皮肤出现黄疽，肝脾均可肿大，肝区触叩痈明显，约经2-3周后黄疽逐渐消退，精神、食欲好转，肝肿大逐渐消退，病程约1-2个月。②急性无黄疽性肝炎：起病销缓，一般症状较轻，大多不发热，整个病程中始终无黄疽出现，其他症状和体征与急性黄疽性肝炎相似，但发病率高，约占急性肝炎总人数的70%～90%（E错）。